患者，女，48岁，患有胃食管反流病，服用兰索拉唑治疗，近期诊断为高血压，血压160/90mmHg，为了避免加重食管反流症状，应避免使用的降压药是
A. 吲达帕胺
B. 哌唑嗪
C. 卡托普利
D. 氯沙坦
E. 硝苯地平

正确答案：E。硝苯地平

解析：本题考查胃食管反流病。硝苯地平（E对）长期服用会引起下食管括约肌松弛，加重反流。吲达帕胺（A错）不良反应为血钾降低、血钠降低及血尿酸升高。哌唑嗪（B错）不良反应为直立性低血压。卡托普利（C错）、氯沙坦（D错）不良反应为血钾升高、血管性水肿。